男性，25岁，车祸伤1小时，查体：脉搏130次/分，血压86/60mmHg，烦躁不安，发绀，严重呼吸困难，皮肤湿冷，左颈胸部皮下捻发感，气管右移，左胸饱满，左肺呼吸音消失，胸片示左肺完全萎陷。经急救处理，病情好转后又迅速恶化，此时治疗应立即
A. 气管切开
B. 清除呼吸道分泌物
C. 左胸膜腔闭式引流
D. 静脉快速输血补液
E. 多头胸带包扎固定胸壁

正确答案：C。左胸膜腔闭式引流

解析：男性，25岁，车祸伤1小时，查体：脉搏130次/分，血压86/60mmHg（血压下降，提示腔静脉回流障碍），烦躁不安，发绀，严重呼吸困难，皮肤湿冷（休克，缺氧），左颈胸部皮下捻发感（皮下气肿），气管右移，左胸饱满，左肺呼吸音消失，胸片示左肺完全萎陷（提示左侧胸膜腔压力高于大气压），综上考虑诊断为左侧张力性气胸。张力性气胸是可迅速致死的危急重症，急救穿剌胸膜腔减压后患者又迅速恶化，此时进一步的治疗应选择左胸膜腔闭式引流（C对），加快排出气体，促使肺膨胀。